湿温发热的特点是
A. 恶寒发热，鼻塞流涕，舌红苔薄白
B. 午后或入夜发热，伴见盗汗，颧红，舌干红
C. 日晡潮热，大便干结
D. 寒热往来，发无定时
E. 午后热甚，身热不扬

正确答案：E。午后热甚，身热不扬

解析：湿温潮热的特点是午后热甚，兼见身热不扬（E对）（即肌肤初们之不觉很热，但们之稍久即感灼手），头身困重等。因湿邪黏腻，湿遏热伏，故身热不扬；午后阳气盛，故午后发热明显。恶寒发热是指患者恶寒与发热同时出现，是表证的特征性症状（A错）。午后或入夜发热，伴见盗汗，颧红，舌干红为阴虚潮热，多属阴虚火旺所致（B错）。日晡潮热，大便干结属阳明潮热，常见于伤寒之阳明腑实证（C错）。寒热往来是指患者自觉恶寒与发热交替发作的症状，是正邪相争，互为进退的病理反映，常见于伤寒病的少阳病，或温病的邪伏膜原，为邪在半表半里的特征。因外感病邪至半表半里阶段时，正邪相争，正胜则发热，邪胜则恶寒，故恶寒与发热交替发作，发无定时（D错）。